螺旋甾烷醇和异螺旋甾烷醇类皂苷元的结构特征有
A. 由 27个碳原子组成
B. 由 30个碳原子组成
C. 由 A、B、C、D四个环组成
D. 由 A、B、C、D、E、F六个环组成
E. E和 F环以螺缩酮形式连接

正确答案：A、D、E。由 27个碳原子组成；由 A、B、C、D、E、F六个环组成；E和 F环以螺缩酮形式连接